患者，女，78岁。因患高血压病长期口服硝苯地平控释片（规格为30mg*24片），后续又出现头晕、恶心、心悸、胸闷，随后就医。硝苯地平控释片的包衣材料是
A. 卡波姆
B. 聚维酮
C. 醋酸纤维素
D. 羟丙甲纤维素
E. 醋酸纤维素酞酸酯

正确答案：C。醋酸纤维素

解析：本题考查硝苯地平控释片中各辅料的作用。醋酸纤维素（C对）为包衣材料。硝苯地平渗透泵片：处方中氯化钾和氯化钠为渗透压活性物质；聚环氧乙烷为助推剂；HPMC为黏合剂；硬脂酸镁为润滑剂；醋酸纤维素为包衣材料；PEG为致孔剂；三氯甲烷和甲醇为溶剂；羟丙甲纤维素（D错）、聚维酮（B错）、卡波姆（A错）为亲水性凝胶骨架缓释材料；肠溶性高分子包衣膜型缓释材料有醋酸纤维素酞酸酯（E错）、羟丙甲纤维素酞酸酯等。